根据中药“十八反”与海藻相反的中药是
A. 瓜蒌
B. 白芍
C. 丹参
D. 甘草
E. 乌头

正确答案：D。甘草

解析：本题考查的是“十八反”配伍禁忌。根据中药“十八反”与海藻相反的中药是甘草（D对）。“十八反”配伍禁忌：本草明言十八反，半蒌贝蔹及攻乌。藻戟芫遂俱战草，诸参辛芍叛藜芦。十八反列述了三组相反药，分别是：甘草反甘遂、京大戟、海藻、芫花；乌头（E错）（川乌、附子、草乌）反半夏、瓜蒌（A错）（全瓜蒌、瓜蒌皮、瓜蒌仁、天花粉）、贝母（川贝、浙贝）、白蔹、白及；藜芦反人参、南沙参、丹参（C错）、玄参、苦参、细辛、芍药（赤芍、白芍（B错））。